患者，男，35岁，有每日饮酒习惯。因牙龈炎口服甲硝唑，治疗期间如常饮酒后出现面部潮红、头痛、头晕、胸闷等症状，最可能的原因是
A. 酒精引起的过敏反应
B. 酒精引起的胃肠道反应
C. 甲硝唑引起的胃肠道反应
D. 甲硝唑引起的周围神经炎
E. 双硫仑样反应

正确答案：E。双硫仑样反应

解析：本题考查双硫仑样反应。因牙龈炎口服甲硝唑，治疗期间如常饮酒后出现面部潮红、头痛、头晕、胸闷等症状，最可能的原因是双硫仑样反应（E对）。甲硝唑属于硝基咪唑类，可干扰酒精的氧化过程，引起体内乙醛蓄积，导致“双硫仑样”反应。异烟肼常用剂量的不良反应发生率较低，剂量加大至6mg/kg时，不良反应率显著增加，主要为肝脏毒性及周围神经炎（D错），加用维生素B₆虽可减少毒性反应，但也可影响疗效。